目前感染人类的禽流感病毒亚型中，感染者病情重，病死率高的是
A. H5N1
B. H9N2
C. H7N7
D. H7N3
E. H7N2

正确答案：A。H5N1

解析：通常情况下，禽流感病毒并不感染人类，但自1997年禽甲型流感病毒H5N1亚型感染人类以来，相继出现H9N2、H7N7等亚型感染人类报道。其中高致病性禽流感的病原体常为H5N1（A对）亚型，且病情严重，并可出现毒血症、感染性休克、多脏器功能衰竭等多种并发症，在儿童还可并发Reye综合征，严重者可致死亡。